前角运动细胞位于脊髓灰质的板层构筑
A. III层
B. V层
C. VI层
D. IX层
E. X层

正确答案：D。IX层

解析：前角运动细胞位于脊髓灰质的IX层（D对），支配骨骼肌运动。脊髓灰质III层（A错）主要接受后根传入纤维。V层（B错）接受来自于皮肤、肌肉和内脏传入的细纤维。VI层（C错）接受本体感觉和一些皮肤的初级传入纤维。X层（E错）接受部分后根的纤维。